下列有关血浆氟说法不正确的是
A. 氟不易通过血脑屏障
B. 大部分血浆氟都是离子型
C. 血浆氟通常有两种存在形式
D. 血浆游离氟一般为0.06～0.08mg/L
E. 胎儿血氟水平约为母体血氟水平的75%

正确答案：D。血浆游离氟一般为0.06～0.08mg/L

解析：本题考查人体氟摄入及代谢、氟防龋。血浆氟通常也有两种存在形式，一种为离子型（游离氟），另一种为非离子氟（结合氟）。几乎所有血浆氟都是离子型，它不与血浆蛋白，或其他成分或软组织结合参与生理代谢过程。在正常情况下，血浆游离氟一般为0.01～0.02mg/L（D错，为本题正确答案）。母体内的氟化物可通过胎盘进入胎儿体内，胎儿血氟水平约为母体血氟水平的75%，说明胎盘起到部分屏障作用。脑的氟含量最低。提示氟不易通过血脑屏障。